WH0提出的机体对于致癌物的反应不包括
A. 试验组发生对照组没有的肿瘤类型
B. 试验组一种或多种肿瘤的发生率明显高于对照组
C. 试验组每个动物的平均肿瘤数明显多于对照组
D. 试验组发生肿瘤的组织器官功能明显低于对照组
E. 试验组肿瘤的发生时间早于对照组

正确答案：D。试验组发生肿瘤的组织器官功能明显低于对照组